属于《医疗机构制剂注册管理办法》许可事项变更的是
A. 法人变更
B. 医疗机构类别变更
C. 机构注册地址变更
D. 制剂配制地址变更
E. 医疗机构名称变更

正确答案：D。制剂配制地址变更

解析：本题考查的是医疗制剂许可证的变更。属于《医疗机构制剂注册管理办法》许可事项变更的是制剂配制地址变更（D对）。《医疗机构制剂许可证》变更分为许可事项变更和登记事项变更。许可事项变更是指制剂室负责人、配制地址、配制范围的变更；登记事项变更是指医疗机构名称（E错）、医疗机构类别（B错）、法定代表人（A错）、注册地址（C错）等事项的变更。